桡骨
A. 与肱骨头相关节
B. 下端有桡切迹与尺骨相关节
C. 桡骨颈前下方有桡骨粗隆
D. 下端内侧向下突出称茎突
E. 桡骨头和桡骨茎突可在体表扪到

正确答案：E。桡骨头和桡骨茎突可在体表扪到

解析：桡骨上端膨大称桡骨头, 头上面的关节凹与肱骨小头相关节（A错），下端内面有关节面，称尺切迹，与尺骨头相关节（B错），桡骨颈的内下侧有突起的桡骨粗隆（C错），下端前凹后凸，外侧向下突出，称茎（D错）。体表可扪及桡骨茎突和桡骨头（E对）。